在手术前的道德要求中不正确的是
A. 医生必须先判断手术对患者的治疗是最优选择
B. 必须做到知情同意
C. 必须认真做好术前各项准备工作
D. 在抢救的情况下，患者不能签字又没有家属在场的情况下医生可以暂时不做手术
E. 医生在术前应尽量把可能发生的术后并发症如实列在知情同意书上

正确答案：D。在抢救的情况下，患者不能签字又没有家属在场的情况下医生可以暂时不做手术

解析：在紧急的抢救情况下，家属不在场，来不及获取患者家属知情同意的时候，医务人员出于对患者责任和利益的考虑，可以行使特殊干涉权，做出对患者有利的决定（D错，为本题正确答案）。手术前的伦理要求包括：1.确定手术治疗的充分性和必要性（A对）。2.保证患者的知清同意权（BE对）。3.认真做好术前准备（C对）。